用甲醇或乙醇从中药中提取生物碱，可提出
A. 游离生物碱
B. 生物碱无机酸盐
C. 生物碱有机酸盐
D. 季铵型生物碱
E. 酸碱两性生物碱

正确答案：A、B、C、D。游离生物碱；生物碱无机酸盐；生物碱有机酸盐；季铵型生物碱

解析：本题考查的是生物碱的溶解性。用甲醇或乙醇从中药中提取生物碱，可提出游离生物碱（A对）、生物碱无机酸盐（B对）、生物碱有机酸盐（C对）与季铵型生物碱（D对）。生物碱的溶解性：1.游离生物碱：（1）亲脂性生物碱：多数具仲胺和叔胺氮原子的生物碱有较强的脂溶性，易溶于乙醚、苯和卤烃类（二氯甲烷、三氯甲烷、四氯化碳等）等有机溶剂中，尤其在三氯甲烷中溶解度较大；可溶于甲醇、乙醇、丙酮和乙酸乙酯等；不溶或难溶于水，但易溶于酸水。（2）亲水性生物碱：①季铵型生物碱：这类生物碱为离子型化合物，易溶于水和酸水，可溶于甲醇、乙醇及正丁醇等极性较大的有机溶剂，难溶于亲脂性有机溶剂。②含N-氧化物结构的生物碱：这类生物碱具配位键结构，可溶于水，如氧化苦参碱。③小分子生物碱：少数分子较小而碱性较强的生物碱，既可溶于水，也可溶于三氯甲烷，如麻黄碱、烟碱等。④酰胺类生物碱：由于酰胺在水中可形成氢键，所以在水中有一定的溶解度，如秋水仙碱、咖啡碱。（3）具有特殊官能团的生物碱：①具有酚羟基或羧基的生物碱：这类生物碱称为两性生物碱（E错），既可溶于酸水，也可溶于碱水溶液。具有酚羟基的生物碱（常称为酚性生物碱），可溶于氢氧化钠等强碱性溶液，如吗啡；具有羧基的生物碱可溶于碳酸氢钠溶液，如槟榔次碱。②具有内酯或内酰胺结构的生物碱：这类生物碱在正常情况下，其溶解性类似一般叔胺碱，但在强碱性溶液中加热，其内酯（或内酰胺）结构可开环形成羧酸盐而溶于水中，酸化后环合析出。如喜树碱、苦参碱等。某些生物碱溶解性不符合上述规律，如吗啡为酚性生物碱，但难溶于三氯甲烷、乙醚；石蒜碱难溶于有机溶剂，而溶于水；喜树碱不溶于一般有机溶剂，而溶于酸性三氯甲烷等。2.生物碱盐：生物碱盐一般易溶于水，可溶于甲醇、乙醇，难溶或不溶于亲脂性有机溶剂。生物碱在酸水中成盐溶解，调碱性后又游离析出沉淀，可利用此性质提取分离生物碱。生物碱盐在水中的溶解性因其成盐的种类不同而有差异。一般生物碱无机酸盐的水溶性大于有机酸盐，无机酸盐中含氧酸盐的水溶性大于卤代酸盐；在有机酸盐中，小分子有机酸盐或多羟基酸盐（如酒石酸盐）水溶性大于大分子有机酸盐。某些生物碱盐难溶于水，如小檗碱盐酸盐、麻黄碱草酸盐等。